光辐射是引起皮肤癌的主要原因，其中波长多见
A. 200～300nm
B. 320～400nm
C. 320～450nm
D. 350～450nm
E. 350～550nm

正确答案：B。320～400nm

解析：本题考查口腔癌发生的危险因素-光辐射。光辐射是引起皮肤癌的主要原因，其中波长多见320～400nm（B对）。口腔癌发生的危险因素：（一）不良的生活方式：1.吸烟：口腔癌的危险度与吸烟量、吸烟时间的长短成正相关。2.咀嚼槟榔：咀嚼槟榔与口腔黏膜的纤维性变呈正相关，也是口腔癌的危险因素之一。口腔癌的发生与嚼槟榔的时间、槟榔在口腔的滞留时间呈正相关，最常发生的部位是颊部，嚼槟榔者患颊癌的危险性是不嚼槟榔的7倍。3.饮酒：饮酒量越大发生口腔癌的危险性越高。（二）环境因素：1.光辐射：光辐射（波长320～400nm）是皮肤癌的主要危险因素，长期强烈光照是引起唇癌的危险因素。唇癌多发生在下唇，患者有明显的职业特点，如农民与户外工作人员患病率高。2.核辐射：核辐射对人有致癌作用。3.环境污染。（三）生物感染：1.感染：病毒、细菌的感染与癌症有着密切的关系。2.慢性刺激与损伤。（四）其他：口腔癌的致病因素是复杂的、综合的，它还与营养不良、缺乏运动、遗传、年龄、种族、药物等有关系。